既往身体健康的成年人，社区获得性肺炎的常见病原不包括
A. 铜绿假单胞菌
B. 肺炎支原体
C. 肺炎衣原体
D. 流感嗜血杆菌
E. 肺炎链球菌

正确答案：A。铜绿假单胞菌

解析：社区获得性肺炎（CAP）是指在医院外罹患的感染性肺实质炎症，包括具有明确潜伏期的病原体感染而在入院后平均潜伏期内发病的肺炎。CAP常见病原体为肺炎链球菌（E对）、支原体（B对）、衣原体（C对）、流感嗜血杆菌（D对）和呼吸道病毒。铜绿假单胞菌（A错，为本题正确答案）主要见于医院获得性肺炎中有感染高危因素的患者。